男，32岁。左上腹被撞伤后钝痛1天，突发腹痛加重3小时。查体：P140次/分，BP60/45mmHg，面色苍白，四肢厥冷，双肺呼吸音清，心率140次/分，上腹中度压痛，肌紧张，移动性浊音（+）。腹腔穿刺抽出不凝血。最可能的诊断是
A. 肝破裂
B. 脾破裂
C. 结肠破裂
D. 小肠破裂
E. 胃破裂

正确答案：B。脾破裂

解析：男，32岁。左上腹被撞伤（腹部损伤史）后钝痛1天，突发腹痛加重3小时。查体：P140次/分，BP60/45mmHg（血压降低），面色苍白，四肢厥冷，双肺呼吸音清，心率140次/分（心率增快），上腹中度压痛，肌紧张，移动性浊音（+）。腹腔穿刺抽出不凝血（诊断性腹腔穿刺）。根据病史、临床表现、辅助检查，最可能的诊断是脾破裂（B对）（P323）。脾是腹腔脏器最容易受损的器官之一，脾脏损伤的发生率在腹部创伤中可高达40%~50%，在腹部闭合性损伤中，脾脏破裂占20%~40%，在腹部开放性损伤，脾破裂约占10%。肝脏损伤在腹部损伤中占20%~30%，右肝破裂较左肝为多。肝外伤的致伤因素、病理类型和临床表现与脾外伤相似，主要危险是失血性休克、胆汁性腹膜炎和继发感染。因肝外伤后可能有胆汁溢出，故腹痛和腹膜刺激征常较脾破裂伤者更为明显（A错）（P323）。